判断生命价值的依据是
A. 内在价值
B. 外在价值
C. 生命质量
D. 健康程度
E. 内在价值与外在价值的统一

正确答案：E。内在价值与外在价值的统一

解析：生命价值论把人的生命的价值作为应该如何对待人的生命的尺度。生命的内在价值与外在价值的统一，构成一个人的生命价值（E对）。生命价值包括两个方面：一是生命所具有的满足这个人自身的效用，即生命的内在价值自我价值，它是由生命质量来决定的（A错）；二是生命的外在价值，即把内在价值发挥出来，为社会创造物质财富和精神财富的社会价值，或称生命的社会价值（B错）。生命质量论是在认同生命神圣的基础上，把注意力集中在对生命质量的考察，主张医学不仅在于保存人的性命，更重要的是要努力提高 增进人的生存质量（C错）。用生命价值观去指导我们的医疗实践，既要看到人的生命的内在价值，也要看到生命的外在价值，既要重视生命的生物学生命的存在（D错），又要重视人的人格生命的社会意义，这是生命价值论的核心所在。